Calot三角组成包括肝脏下缘、胆囊管和
A. 副胆管
B. 胆总管
C. 肝总管
D. 右肝管
E. 左肝管

正确答案：C。肝总管

解析：胆囊管、肝总管（C对）、肝脏下缘所构成的三角区称为Calot三角。副胆管（A错）是胆道变异的一种，其位置不恒定不能作为定位标志。肝总管和胆囊管在肝十二指肠韧带内汇合成胆总管（B错）向下与胰管相会合。右肝管（D错）左肝管（E错）出肝后汇合而成肝总管。